伤寒的皮疹属
A. 斑丘疹
B. 丘疹
C. 出血疹
D. 疱疹
E. 荨麻疹

正确答案：B。丘疹

解析：伤寒的玫瑰疹属于丘疹（B对）。麻疹、风疹、登革热、猩红热可见斑疹丘疹混合存在（A错）。出血疹：亦称瘀点，多见于肾综合征出血热、登革热和流行性脑脊髓膜炎等传染病（C错）。疱疹：多见于水痘、单纯疱疹和带状疱疹等病毒性传染病，亦可见于立克次体痘及金黄色葡萄球菌败血症等（D错）。荨麻疹：可见于病毒性肝炎、蠕虫蚴移行症和丝虫病等（E错）。